脾虚湿盛的常见症状是
A. 口角糜烂
B. 口角流涎
C. 口唇皲裂
D. 唇色淡白
E. 面黑而干

正确答案：B。口角流涎